氯霉素的主要不良反应有
A. 骨髓抑制
B. 再生障碍性贫血
C. 二重感染
D. 肾毒性
E. 灰婴综合征

正确答案：A、B、D、E。骨髓抑制；再生障碍性贫血；肾毒性；灰婴综合征

解析：本题考查氯霉素的不良反应。氯霉素的主要不良反应有：骨髓抑制（A对）、再生障碍性贫血（B对）、肾毒性（D对）、灰婴综合征（E对）。二重感染是指长期使用广谱抗生素，可使敏感菌群受到抑制，而一些不敏感菌（如真菌等）乘机生长繁殖，产生新的感染。氯霉素不会引起二重感染（C错）。